疾病三间分布长期变异的原因不包括
A. 社会人口学资料的变化
B. 病后免疫持续时间的长短
C. 抗原型别变异，病原体毒力、致病力的变化
D. 诊疗技术的进步、防制措施的改善
E. 病因或致病因素发生了变化

正确答案：B。病后免疫持续时间的长短

解析：长期变异的原因有：①病因或致病因素发生了变化：②抗原型别变异，病原体毒力、致病力的变化和机体免疫状况的改变；③诊疗技术的进步、防制措施的改善：④社会人口学资料的变化及疾病的诊断、报告标准的改变等。掌握“流行病学资料与疾病分布”知识点。